口内法进行下牙槽神经阻滞麻醉时，进针点在
A. 腮腺导管口下、后1cm处
B. 磨牙后三角区
C. 翼下颌韧带中点外3～4mm，与颊脂垫尖端交汇处
D. 翼下颌韧带中点内侧0.5cm处
E. 下颌第一双尖牙根下0.5cm处

正确答案：C。翼下颌韧带中点外3～4mm，与颊脂垫尖端交汇处

解析：本题考查下牙槽神经阻滞麻醉。口内法进行下牙槽神经阻滞麻醉时，进针点在翼下颌韧带中点外3～4mm，与颊脂垫尖端交汇处（C对）。口内法进行下牙槽神经阻滞麻醉是将麻药注射到翼下颌间隙内，故亦称翼下颌注射法，针尖一般应达到下颌小舌平面以上的下颌神经沟附近，麻药扩散后可麻醉下牙槽神经。在患者大张口时，可见磨牙后方，腭舌弓之前，有纵行的黏膜皱襞，名翼下颌皱襞，其深面为翼下颌韧带；另在颊部有一由脂肪组织突起形成的三角形颊脂垫，其尖端正居翼下颌韧带中点而稍偏外处，此二者即为注射的重要标志，注射时可在翼下颌韧带中点外3～4mm，与颊脂垫尖端交汇处进针。若遇颊脂垫尖不明显或磨牙缺失的患者，可在大张口时，以上、下颌牙槽突相距的中点线与翼下颌皱襞外侧3～4mm的交点，作为注射标志。按注射标志进针，推进约2～2.5cm左右，可达下颌骨骨面的下颌神经沟，可麻醉同侧下颌骨、下颌牙、牙周膜、前磨牙至中切牙唇颊侧牙龈、黏骨膜及下唇。